男婴，1个月，腹胀，便秘1个月，查体：腹部明显隆起，腹壁静脉显露明显，肠鸣音较活跃，肛门指检时排出恶臭气体及大便，腹部立位X线平片可多个阶梯状液平。考虑的诊断是
A. 坏死性小肠结肠炎
B. 先天性巨结肠
C. 功能性便秘
D. 先天性肠旋转不良
E. 胎粪塞综合征

正确答案：B。先天性巨结肠

解析：婴儿，1个月，腹胀，便秘（先天性巨结肠的典型临床表现）1个月，查体：腹部明显隆起，腹壁静脉显露明显、肠鸣音较活跃（先天性巨结肠的典型体征），肛门指检时排出恶臭气体及大便，腹部立位X线平片可多个阶梯状液平（提示肠梗阻），根据患者的临床症状、体征及实验室检查，考虑最可能的诊断为先天性巨结肠（B对），该病是由于直肠或结肠远端的肠管持续痉挛，粪便淤滞在近端结肠，使该肠管肥厚、扩张。坏死性小肠结肠炎（A错）本病多为早产儿，围生期多有窒息、缺氧、感染、休克的病史，且有便血。X线平片示肠壁有气囊肿和（或）门静脉积气。功能性便秘（C错）是一种原因不明的慢性便秘，立位腹平片多正常。先天性肠旋转不良（D错）生后2-4天开始发生呕吐，主要是以十二指肠梗阻的形式来表现出来。胎粪综合征（E错）由于胎粪浓缩稠厚，可出现一过性低位肠梗阻症状，经灌肠排出胎粪后，即可正常排便且不再复发。